变异型心绞痛，不宜使用
A. 硝酸甘油软膏
B. 硝酸甘油贴片
C. 普萘洛尔
D. 硝苯地平
E. 地尔硫卓

正确答案：C。普萘洛尔

解析：普萘洛尔主要用于治疗稳定型心绞痛，疗效肯定，能减少发作次数。对不稳定型心绞痛，也有一定疗效。对兼有高血压或心律失常患者更为适用。但因能引起冠状动脉收缩，不宜用于变异型心绞痛（C对）。